在一个心动周期中，主动脉血压达到的最低值称为
A. 收缩压
B. 舒张压
C. 脉压
D. 平均动脉压
E. 循环系统平均充盈压

正确答案：B。舒张压